欲用统计图比较1994～2003年城市和农村3岁以下儿童贫血患病率的变化趋势，选用何种统计图形最为合适
A. 条图
B. 半对数线图
C. 圆图
D. 直方图
E. 散点图

正确答案：B。半对数线图